处方写番木鳖，应付
A. 马钱子
B. 山栀子
C. 番泻叶
D. 海南子
E. 木鳖子

正确答案：A。马钱子

解析：本题考查的是饮片处方的药品名称。处方写番木鳖，应付马钱子（A对）。马钱子别名：番木鳖、马前、马前子。山栀子（B错）为栀子的别名，应付栀子。栀子别名：山栀子、山栀。番泻叶（C错）本为正名，应付番泻叶。海南子（D错）为槟榔的别名，应付槟榔。槟榔别名：花槟榔、大腹子、海南子。木鳖子（E错）本为正名，应付木鳖子。